参与蛋白质合成的酶是
A. RNA聚合酶
B. 转肽酶
C. 引物酶
D. 逆转录酶
E. DNA聚合酶

正确答案：B。转肽酶

解析：参与蛋白质合成的酶主要是氨基酸-tRNA合成酶和转肽酶（B对）。RNA聚合酶（A错）参与的是转录过程。引物酶（C错）和DNA聚合酶（E错）参与的是DNA复制过程。逆转录酶（D错）参与的是以RNA为模板合成cDNA，以及以cDNA为模板合成双链DNA的过程。